不属于口腔颌面部深静脉的是
A. 翼静脉丛
B. 上颌静脉
C. 面总静脉
D. 下颌后静脉
E. 面静脉

正确答案：E。面静脉

解析：口腔颌面部浅静脉主要有面静脉、颞浅静脉，位置较浅。口腔颌面部深静脉主要有翼静脉丛、上颌静脉、下颌后静脉与面总静脉，位置较深。掌握“口腔颌面颈部主要静脉的回流途径与范围”知识点。